患者害怕独处，唯恐发生意外，期盼亲人的呵护，这一现象说明患者未被满足的需要是
A. 生存需要
B. 自我成长需要
C. 安全需要
D. 归属需要
E. 自尊需要

正确答案：C。安全需要

解析：马斯洛的需要层次论：1.生理的需要2.安全的需要3.归属和爱的需要4尊重的需要5.自我实现的需要。生存需要（A错）是个体生存必不可少的需要，具有自我和种族保存的意义。其中以饥饿和渴的需要为主。安全需要（C对）包括对生命安全、财产安全、职业安全和心理安全的需要。归属需要（D错）就是参加一定的组织，依附于某个团体等。自尊需要（E错）是个体对自身价值的认同。自我实现的需要（B错）指个体的潜能和天赋得到充分的发挥。患者害怕独处，唯恐发生意外，期盼亲人的呵护，这一现象说明患者未被满足的需要是安全需要（C对）。